女，21岁。1型糖尿病8年，平素每日4次（R-R-R-N）胰岛素皮下注射治疗，定期查糖化血红蛋白7.5%～8%，2日前患者受凉后发热，体温37.5℃～38℃，因食欲不佳，自行停用胰岛素，改用阿卡波糖治疗。渐出现恶心。食欲不振，呕吐少量胃内容物，尿中有异味。查体：102次/分。BP90/60mmHg，体重55Kg，轻度脱水貌，精神萎靡，实验室检查：随机血糖25.6mmol/L，血钾4.8mmol/L，血纳144mmol/L，尿糖（++++），尿酮体（+++）；动脉血气分析pH值7.25。该患者pH值降低，合理的治疗是
A. 静脉滴注0.9%生理盐水
B. 静脉注射5%碳酸氢钠，至血pH值正常
C. 静脉滴注1.25%碳酸氢钠，至血pH值正常
D. 静脉滴注1.25%碳酸氢钠，至尿酮体转阴
E. 静脉滴注5%碳酸氢钠至尿酮体转阴

正确答案：A。静脉滴注0.9%生理盐水

解析：该患者PH＞7.1，因此不需要补碱。该患者pH值降低，合理的治疗是输液和胰岛素治疗。